口腔中常用的尖锐器械包括
A. 冲洗针头
B. 缝合针
C. 外科解剖刀片
D. 根管治疗的扩大针
E. 以上都是

正确答案：E。以上都是

解析：口腔中常用的尖锐器械包括冲洗针头、注射针头、缝合针、外科解剖刀片、根管治疗的扩大针、探针、慢速车针、金属成形片、注射用的玻璃麻醉药以及其他玻璃制品、矫治用的各种钢丝、挖器、牙周刮治器等。掌握“患者、医务人员及环境的防护”知识点。